患者，女，19岁，未婚。月经提前，量少、色红、质黏稠，伴手足心热，两颧潮红，舌红少苔，脉细数。治疗应首选
A. 大补元煎
B. 丹栀逍遥散
C. 清经散
D. 保阴煎
E. 两地汤

正确答案：E。两地汤

解析：根据题目可知，月经提前，量少、色 红、质黏稠，伴手足心热，两颧潮红，舌红少苔，脉细数，是阴虚血热的征象，故该患者为月经先期阴虚血热证。治疗上要养阴清热调经，选择两地汤滋阴降水，使得水足则火自灭，阴复而阳自秘，则经行如期（E对）。大补元煎，原方治疗男、妇气血大坏，精神失守，危剧等证。可用于治疗月经后期血虚证以补血益气调经（A错）。丹栀逍遥散原方治肝脾血虚发热，或潮热，或自汗盗汗，或头痛目涩，或怔仲不宁，或颊赤口干，或月经不调…。可用于月经先期肝郁血热证以疏肝清热，凉血调经（B错）。清经散原方治疗月经先期量多者。可用于月经先期阳盛血热证以清热凉血调经（C错）。保阴煎原方治男、妇带、浊遗、淋，色赤带血，脉滑多热，便血不止及血崩血淋，或经期太早等阴虚血热动血证。主要功效为清热凉血，固冲止血，本方加减主要用于治疗月经过多、胎漏、胎动不安和恶露不绝血热证（D错）。